呈筒状或半筒状。内表面淡灰色或浅棕色，常见发亮的结晶，断面较平坦，淡粉红色，显粉性的药材是
A. 桑白皮
B. 白鲜皮
C. 地骨皮
D. 牡丹皮
E. 香加皮

正确答案：D。牡丹皮

解析：本题考查的是牡丹皮药材的性状鉴别。呈筒状或半筒状。内表面淡灰色或浅棕色，常见发亮的结晶，断面较平坦，淡粉红色，显粉性的药材是牡丹皮（D对）。牡丹皮：【性状鉴别】药材呈筒状或半筒状，有纵剖开的裂缝，略向内卷曲或张开。外表面灰褐色或黄褐色，有多数横长皮孔样突起及细根痕，栓皮脱落处粉红色；内表面淡灰黄色或浅棕色，有明显的细纵纹，常见发亮的结晶。质硬而脆，易折断，断面较平坦，淡粉红色，粉性。气芳香，味微苦而涩。桑白皮（A错）：【性状鉴别】药材呈扭曲的卷筒状、槽状或板片状，长短宽窄不一。外表面白色或淡黄白色，较平坦，有的残留橙黄色或棕黄色鳞片状粗皮；内表面黄白色或淡黄色，有细纵纹。体轻，质韧，纤维性强，难折断，易纵向撕裂，撕裂时有粉尘飞扬。气微，味微甘。白鲜皮（B错）：【性状鉴别】药材呈卷筒状。外表面灰白色或淡灰黄色，具细纵皱纹及细根痕，常有突起的颗粒状小点；内表面类白色，有细纵纹。质脆，折断时有粉尘飞扬，断面不平坦，略呈层片状，剥去外层，迎光可见有闪烁的小亮点。有羊膻气，味微苦。地骨皮（C错）：【性状鉴别】药材呈筒状或槽状，外表面灰黄色至棕黄色，粗糙，有不规则纵裂纹，易成鳞片状剥落。内表面黄白色至灰黄色，较平坦，有细纵纹。体轻，质脆，易折断，断面不平坦。外层黄棕色，内层灰白色。气微，味微甘而后苦。香加皮（E错）：【性状鉴别】药材呈卷筒状或槽状，少数呈不规则的块片状。外表面灰棕色或黄棕色，栓皮松软常呈鳞片状，易剥落。内表面黄色或淡黄棕色，较平滑，有细纵纹。体轻，质脆，易折断，断面不整齐，黄白色。有特异的香气，味苦。